肠伤寒穿孔易发生于
A. Peyer斑
B. Meckel憩室
C. colicbands
D. McBurney点
E. Houston瓣

正确答案：A。Peyer斑

解析：Peyer斑(A对)为集合淋巴滤泡，为易发生肠伤寒穿孔的部位。